患者，女，45岁。因患乳腺癌在3个月前行乳腺癌根治术，术中曾输血800mL，在最近追踪检查过程中发现血清ALT150U/L，进一步查肝炎病毒感染标志物发现甲肝抗体阳性，抗—HBs阳性，丙肝抗体阳性，丁肝和戊肝抗体均阴性。该病例最可能的诊断是
A. 手术后谷丙转氨酶升高
B. 脂肪肝
C. 输血后丙型肝炎
D. 转移性肝癌
E. 输血后病毒性肝炎，乙丙肝病毒重叠感染

正确答案：C。输血后丙型肝炎

解析：患者因术中输血后，出现肝功能异常（ALT150U/L），ALT正常值为0-40U/L，甲肝抗体阳性提示患者曾感染过甲型肝炎，抗-HBs阳性提示患者对乙型肝炎具有免疫力，而丙肝抗体阳性提示患者输血后感染丙型肝炎，该病例最可能的诊断是输血后丙型肝炎（C对），丙肝抗体是丙型肝炎感染后的标志，非保护性抗体，于HCV感染后4～8周才能在血中检出，在丙型肝炎恢复或治愈后仍持续存在。若为手术后谷丙转氨酶升高（A错）或者脂肪肝（B错），则肝炎病毒感染标志物应正常。转移性肝癌（D错）应有癌症的恶病质表现及上腹部包块、乏力、肝区痛等表现，诊断主要依靠病理检查。抗HBs阳性提示患者对乙型肝炎病毒再感染具有保护作用，丙肝抗体阳性提示患者感染丙型肝炎病毒，而非输血后病毒性肝炎，乙丙肝病毒重叠感染（E错）。